动物类食物中，必需脂肪酸含量最多的是
A. 猪油
B. 肥肉
C. 瘦肉
D. 羊脂
E. 鱼肉

正确答案：E。鱼肉